下列关于龋齿流行病的说法，错误的是
A. 龋患率与社会经济状况、生活习惯、饮食结构等密切相关
B. 发达国家龋患率较高，我国学生龋患率低于发达国家水平
C. 由于开展多种综合防治工作，我国学生龋患率正在呈下降趋势
D. 目前，我国儿童青少年龋患率处于WH0规定的“较低水平”
E. 目前，我国城市儿童龋患率城市低于农村

正确答案：C。由于开展多种综合防治工作，我国学生龋患率正在呈下降趋势